脱疽的主要病因病理是
A. 脾气不健，肝肾不足，寒湿侵袭，凝滞脉络
B. 湿热蕴结，寒湿外侵，气血瘀滞，脉络滞塞
C. 湿热下注，气血壅滞，经络阻隔，脉络瘀滞
D. 肝肾不足，气血两亏，络脉闭阻，筋骨失养
E. 情志郁结，气滞血瘀，脉络闭阻，筋脉失养

正确答案：A。脾气不健，肝肾不足，寒湿侵袭，凝滞脉络

解析：脱疽的发病以脾肾亏虚为本，寒湿外伤为标，气血凝滞、经脉阻塞为主（A对）。脱疽发病为寒湿而非湿热（BC错）。脱疽发病为经脉阻而非筋骨失养（D错）。脱疽发病与饮食不节、长期吸烟、环境、遗传及外伤等因素有关，与情志关系不大（E错）。